医务人员在抢救生命垂危的患者等紧急情况下已经尽到了合理诊疗的义务，造成了患者的损害，此种符合医疗损害责任中的那种情形
A. 医疗机构承担赔偿责任的情形
B. 对医疗机构以及其医务人员权益保护的情形
C. 医疗机构承担赔偿责任情形中的未尽到与当时医疗水平相应的诊疗义务
D. 医疗机构有过错的情形中违反了相关的法律法规
E. 医疗机构不承担赔偿责任的情形

正确答案：E。医疗机构不承担赔偿责任的情形

解析：患者有损害，因下列情形之一的，医疗机构不承担赔偿责任：①患者或者其近亲属不配合医疗机构进行符合诊疗规范的诊疗；②医务人员在抢救生命垂危的患者等紧急情况下已经尽到合理诊疗义务；③限于当时的医疗水平难以诊疗。但是在患者或者其近亲属不配合医疗机构进行符合诊疗规范的诊疗情形中，医疗机构及其医务人员也有过错的，应当承担相应的赔偿责任。掌握“医疗损害责任”知识点。